下列关于癌痛患者的镇痛药使用原则，错误的是
A. 按患者疼痛程度分阶梯给药
B. 按时给药，而不是按需给药
C. 提倡无创的给药方式
D. 用药须个体化
E. 疼痛时用药，不疼痛时不用药

正确答案：E。疼痛时用药，不疼痛时不用药

解析：本题考查癌痛患者的镇痛药使用原则。疼痛控制的总体原则是：①按时给药，不是按需给药（E错，为本题正确答案）。②按阶梯给药（A对）。③能口服给药尽量口服给药，提倡无创的给药方式（C对）。④用药个体化（D对）。⑤注意具体细节，如注意不良反应处理。